关于酶活性的叙述，正确的是
A. 关键酶的活性不易被调节
B. 25℃时，TaqDNA聚合酶活性最高
C. 酶活性检测可用于疾病的诊断
D. 多数酶最适pH在8.0
E. 缺少氯离子时唾液淀粉酶失去活性

正确答案：C。酶活性检测可用于疾病的诊断

解析：酶活性检测可用于疾病的诊断（C对），组织器官损伤可使其组织特异性的酶释放入血，有助于对组织器官疾病的诊断。如急性肝炎时血清谷丙转氨酶活性升高；急性胰腺炎时血、尿淀粉酶活性升高；前列腺癌病人血清酸性磷酸酶含量增高；骨癌病人血中碱性磷酸酶含量升高；卵巢癌和睾丸肿瘤病人血中胎盘型碱性磷酸酶升高。细胞根据内外环境的变化而调整细胞内代谢时，主要是通过对催化限速反应的调节酶（亦称为关键酶）的活性进行调节而实现的（P71）（A错）。细胞内酶的最适反应温度与生物生活环境温度相关，TaqDNA聚合酶来源于能在70～75°C环境中生长的栖热水生菌，该酶最适温度为72°C，（B错）。虽然不同酶的最适pH各不相同，但除少数（如胃蛋白酶的最适pH约为1.8，肝精氨酸酶的最适pH为9.8）外，动物体内多数酶的最适pH接近中性（P67）（D错）。Cl⁻是唾液淀粉酶的非必需激活剂，非必需激活剂可增加酶的活性，但缺乏时该酶仍有活性（P71）（E错）。